一个家庭关系紧张的人，尽可能缩短在家逗留的时间，变成一个“工作迷”，这一现象是
A. 应激的行为反应
B. 应激的情绪反应
C. 应激的生理反应
D. 应激的防御反应
E. 以上都不是

正确答案：A。应激的行为反应